有关脊髓的位置和形态的描述哪个是对的
A. 脊髓的颈膨大位于颈髓的第六节至第八节
B. 脊髓的腰膨大位于腰髓的第二节至第五节
C. 脊髓下端成人平对第三腰椎下缘
D. 胸髓的第二节平对第一胸椎椎体
E. 腰髓平对第一腰椎椎体

正确答案：D。胸髓的第二节平对第一胸椎椎体

解析：脊髓上端在枕骨大孔处与延髓相连，下端变细呈圆锥状称脊髓圆锥,尖端约平对第1腰椎下缘（C错）。脊髓呈前、后稍扁的圆柱形，全长粗细不等，有两个梭形膨大部上方的称颈膨大,从第4颈髓节段至第1胸髓节段（A错）。下方的称腰骶膨大,从第1腰髓节段至第3骶髓节段（B错）。根据脊髓节段与椎骨的对应关系，胸髓的第二节平对第一胸椎椎体（D对），腰髓平对第10-12胸椎（E错）。